患者，男，35岁。下痢3个月余，痢下稀薄白冻，腹部隐痛，里急后重，食少神疲，四肢不温，舌淡苔薄白，脉沉细。治疗应首选
A. 桃花汤
B. 驻车丸
C. 芍药汤
D. 胃苓汤
E. 白头翁汤

正确答案：A。桃花汤

解析：题中患者以下痢3个月余，痢下稀薄白冻为主症，故诊断为痢疾。痢下稀薄白冻为脾肾阳虚，寒湿凝滞肠中，阴邪独盛，气分大伤所致；阳虚肠中失于温养，故腹部隐痛。寒湿阻滞，气机不畅，腑气不通，故里急后重；脾主运化，脾阳虚衰，健运失司，故食少神疲，四肢不温；舌淡苔薄白，脉沉细均为虚寒之象，故辨为虚寒痢。治宜温补脾肾，收涩固脱，首选桃花汤合真人养脏汤（A对）。驻车丸功能坚阴养血，清热化湿，常合黄连阿胶汤治疗阴虚痢（B错）。芍药汤功能调气行血，清热解毒，为湿热痢的选方（C错）。胃苓汤功能祛湿和胃，行气利水，可用于治疗寒湿痢（D错）。白头翁汤功能清热凉血解毒，常合芍药汤治疗疫毒痢（E错）。